依据《非处方药专有标识管理规定（暂行）》，必须按照国家药品监督管理部门公布的色标要求印刷非处方专有标识的是
A. 药品标签、使用说明书
B. 药品标签、使用说明书、内包装、外包装
C. 药品标签和内包装、外包装
D. 药品使用说明书和大包装
E. 药品使用说明书和外包装

正确答案：C。药品标签和内包装、外包装

解析：本题考查非处方药专有标识。依据《非处方药专有标识管理规定（暂行）》，必须按照国家药品监督管理部门公布的色标要求印刷非处方专有标识的是药品标签和内包装、外包装（C对）。使用非处方药专有标识时，药品的使用说明书和大包装可以单色印刷，标签和其他包装必须按照国家药品监督管理部门公布的色标要求印刷。单色印刷时，非处方药专有标识下方必须标示“甲类”或“乙类”字样。非处方药专有标识应与药品标签、使用说明书、内包装、外包装一体化印刷，其大小可根据实际需要设定，但必须醒目、清晰，并按照国家药品监督管理部门公布的坐标比例使用。非处方药药品标签、使用说明书和每个销售基本单元包装印有中文药品通用名称（商品名称）的一面（侧），其右上角是非处方药专有标识的固定位置。